左右下56缺失，设计舌杆，牙槽嵴呈倒凹形安放位置是
A. 与黏膜轻轻接触
B. 根据义齿设计类型决定
C. 与黏膜只有0.5mm的间隙
D. 位于非倒凹区
E. 位于倒凹区

正确答案：D。位于非倒凹区

解析：本题考查舌杆与黏膜的关系。在设计舌杆时，由于要防止义齿下沉后压迫软组织，应在舌杆与黏膜间预留一定的缓冲空间，缓冲量根据下颌舌侧牙槽骨的三种形态分为三种不同类型。倒凹型者舌杆在非倒凹区（D对）或在倒凹区留出空隙，并在骨突区充分缓冲。垂直型者舌杆与黏膜轻轻接触（A错），斜坡型者舌杆与黏膜略微分离，与黏膜有0.3-0.5mm的间隙（C错）。